男性，37岁。右下前牙进食骤然咀嚼小石子后出现疼痛，有伸长感1天。口腔检查：右下2叩诊（+），松动I°，牙髓活力电测试无反应。X线牙片示：无根折，牙周间隙增宽。下列治疗措施不当者是
A. 降低咬合
B. 固定松动牙
C. 即刻做根管治疗
D. 1、3、6、12个月定期复查
E. 观察1年后确定是否牙髓治疗

正确答案：C。即刻做根管治疗

解析：本题考查牙震荡的治疗。男性，37岁。右下前牙进食骤然咀嚼小石子后出现疼痛，有伸长感1天。口腔检查：右下2叩诊（+），松动I°，牙髓活力电测试无反应。X线牙片示：无根折，牙周间隙增宽。下列治疗措施不当的是即刻做根管治疗（C错，为本题的正确答案）。患牙为进食时骤然咀嚼小石子造成的牙震荡。患牙有伸长感，应降低咬合以减轻患牙的（牙合）力负担（A对），使患牙得到休息，并及时固定松动的患牙（B对）。受伤后1、3、6、12个月应定期复查（D对）。注意观察患牙牙髓状况，观察1年后，若牙冠不变色，牙髓反应正常，可不进行处理；若牙髓有坏死迹象，应进一步行根管治疗（E对）。